男性，48岁。右季肋区疼痛半年。CT检查示：肝右叶12cm×10cm肿块，包绕、压迫下腔静脉，肝左叶内多个小的低密度结节。进一步检查确诊为原发性肝癌。考虑的治疗方法不包括
A. 肝动脉结扎术
B. 肝动脉栓塞术
C. 肝动脉灌注化疗
D. 肝移植手术
E. 肝叶切除术

正确答案：E。肝叶切除术

解析：患者肝右叶巨大肝癌，侵及下腔静脉，发生肝内转移，手术切除不能完全将癌组织清除，且易发生进一步转移风险，不考虑肝叶切除术（E错，为本题正确答案）。肝动脉结扎术（A对）、肝动脉栓塞术（B对）、肝动脉灌注化疗（C对）可起到一定的治疗效果。肝移植手术（D对）可获得较好的长期效果。